集中式供水水质监测的必测项目是
A. 细菌学指标、浑浊度和肉眼可见物
B. 细菌总数、耐热大肠菌群和游离性余氯
C. 细菌学指标、色度和游离性余氯
D. 细菌总数、总大肠菌群和浑浊度
E. 细菌总数、大肠菌群和色度

正确答案：A。细菌学指标、浑浊度和肉眼可见物

解析：本题考查集中式供水水质监测的必测项目。集中式供水是指由水源集中取水，经统一净化处理和消毒后，通过输配水管送到用户的供水方式。其水质监测的必测项目是细菌学指标、浑浊度和肉眼可见物（A对BCDE错）。